阿司匹林用于心脑血管不良事件二级预防的适宜剂量是
A. 50mg/d
B. 75～150mg/d
C. 300mg/d
D. 500mg/d
E. 1500mg/d

正确答案：B。75～150mg/d

解析：本题考查阿司匹林。阿司匹林口服用于心脑血管事件一级预防，一次75～100mg，一日一次；用于心脑血管事件二级预防，一次75～150mg（B对），一日1次。